下列各种物质中，其肾清除率能准确代表肾小球滤过率的是
A. 尿素
B. 肌酸
C. 菊粉
D. 对氨基马尿酸
E. 碘锐特

正确答案：C。菊粉